汽车正在行驶中，一名儿童突然冲向马路对面。司机急刹车。汽车在发出刺耳的刹车声后停住，儿童在车前的半米处跑过。这时司机顿感心跳加快，头上冒汗，手脚无力。这种情绪状态是
A. 心境
B. 激情
C. 情感
D. 应激
E. 情操

正确答案：D。应激

解析：应激是指机体对各种内、外界刺激因素所作出的适应性反应的过程。应激的最直接表现即精神紧张。生活中遭遇突发事件时，由于紧急的情景刺激了有机体，就能使其激活水平很快改变，引起情绪的高度应激化。在危险的境遇下独立地采取果断的决定，在瞬息变化的情况下作出迅速的反应，这些都是应激状态。应激可能使人的活动变得积极，思想变得清晰明确。人的个性特征在应激反应中起决定作用，迅速的判断力、意志自觉性、意志果断性、坚毅的精神、类似的行为经验，都是积极应激反应不可缺少的条件。掌握“心理应激”知识点。